以下有关乙型肝炎血清学检查项目中，常作为急性乙型肝炎病毒感染的指标是
A. HBsAg
B. HBeAg
C. HBcAb
D. HBc-IgM
E. HBc-IgG

正确答案：D。HBc-IgM

解析：本题考查乙型肝炎血清免疫学检查。以下有关乙型肝炎血清学检查项目中，常作为急性乙型肝炎病毒感染的指标是HBc-IgM（D对）。抗HBc-IgM阳性是诊断急性乙型肝炎和判断病毒复制活跃的指标。HBsAg（A错）是乙型肝炎病毒表面抗原，是乙型肝炎病毒感染最早期血清里出现的一种特异性血清标记物。HBeAg（B错）是乙型肝炎病毒e抗原，是HBV复制的指标之一，位于HBV病毒颗粒的核心部位。HBcAb（C错）是乙型肝炎病毒核心抗体，反映肝细胞受到HBV侵害后的一项指标。HBc-IgG（E错）是乙型肝炎病毒核心抗体中的一型，高滴度表示正在感染HBV，低滴度则表示既往感染过HBV。